某年某社区开展为期一年的糖尿病普查，该社区年初人口数9500人，年末人口数10500人。年初有糖尿病患者100人，年末有糖尿病患者130人，普查期间有10名患者死于糖尿病并发症。该社区普查当年的糖尿病患病率为
A. 130/10500
B. 130/10000
C. 140/10000
D. 140/10500
E. 40/10000

正确答案：C。140/10000